易发生风温的季节是
A. 春
B. 夏
C. 长夏
D. 秋
E. 冬

正确答案：A。春

解析：春天气候多风而温暖，常发生风温（A对）；夏季多发生暑病（B错）；长夏多发生湿病（C错）；秋季多发生燥病（D错）；冬季多发生寒病（E错）。